普通菌毛主要与下列哪一项有关
A. 细菌的运动
B. 细菌的致病性
C. 细菌的抗药性
D. 细菌的鉴别诊断
E. 细菌的遗传变异

正确答案：B。细菌的致病性

解析：普通菌毛可促使细菌黏附于宿主细胞表面而致病。掌握“细菌的特殊结构及检查方法”知识点。